使cAMP升高抑制血小板聚集药物是
A. 氨甲苯酸
B. 链激酶
C. 组织纤溶酶原激活因子
D. 双嘧达莫
E. 华法林

正确答案：D。双嘧达莫